学校教学用房内廊净宽度不应小于
A. 1.1m
B. 1.8m
C. 2.1m
D. 2.8m
E. 3.4m

正确答案：C。2.1m